患者急性子痈2天，恶寒发热，左侧附睾肿大疼痛。疼痛引及子系（精索），舌红苔黄腻，脉滑数，治疗方剂
A. 透脓散
B. 滋阴除湿汤
C. 萆薢化毒汤
D. 五味消毒饮
E. 枸橘汤

正确答案：E。枸橘汤

解析：透脓散为透托法的代表方，适用于肿疡已成（A错）。滋阴除湿汤适用于阴虚湿热证（B错）。萆薢化毒汤适用于湿热疮疡，气血实者（C错）。五味消毒饮适用于热毒炽盛证（D错）。枸橘汤适用于湿热下注证（E对）。